从现代流行病学的观点出发，判断研究因素与非传染性疾病之间存在因果联系必要的条件不包括
A. 联系的时间顺序
B. 联系的强度
C. 联系的特异性
D. 联系的可重复性
E. 联系的合理性

正确答案：C。联系的特异性